女，10岁。因发热15天，皮肤出现红斑，并伴有肘膝关节游走性疼痛入院。辅助检查：ASO升高。治愈出院，为防止复发，应至少肌内注射长效青霉素到
A. 15岁
B. 12岁
C. 11岁
D. 14岁
E. 13岁

正确答案：A。15岁

解析：患儿，发热15天、皮肤出现红斑、有肘膝关节游走性疼痛、ASO常高，符合风湿热的特征，应诊断为风湿热。风湿热患儿为预防风湿热发作，长效青霉素注射时间至少持续5年（患儿10岁），因此治愈，为防止复发，应至少肌内注射长效青霉素到15岁（A对）。